流行病学研究的观察法与实验法的根本区别在于
A. 设立对照组
B. 不设立对照组
C. 是否人为控制研究的条件
D. 盲法
E. 统计学检验

正确答案：C。是否人为控制研究的条件

解析：本题考查流行病学研究观察法和实验法的根本区别。观察法在研究实施中描述或分析人群中的某些现象，从中找出规律性的结论，包括描述性流行病学和分析性流行病学；实验流行病学属于实验法，即有人为给予的干预措施（C对ABDE错），并强调随机分配。因此，是否有人为给予的干预措施是观察法和实验法的根本区别。